易散气味的是
A. 柏子仁
B. 石膏
C. 淡附片
D. 芒硝
E. 月季花

正确答案：E。月季花